下列措施中属于二级预防的是
A. 保健服务
B. 戒烟限酒
C. 定期体检
D. 运动康复
E. 经常性卫生监督

正确答案：C。定期体检

解析：本题考查二级预防。第二级预防又称“三早”预防，即早发现、早诊断、早治疗。是在疾病早期，症状体征尚未表现出来或难以觉察，通过及早发现并诊断疾病，及时给予适当的治疗，有更大的机会实现治愈；或者如果疾病无法治愈，可以通过治疗阻止疾病发展到更严重的阶段或至少减缓发展进程，减少对更复杂的治疗措施的需要。疾病的早发现可通过筛检、病例发现、定期体检（C对ABDE错）等实现。